患者短暂性脑缺血发作，头晕目眩，头重如蒙，肢体麻木，胸脘痞闷，舌质黯，苔白腻，脉滑数，其首选方剂是
A. 补阳还五汤合桃红四物汤
B. 镇肝熄风汤合血府逐瘀汤
C. 黄连温胆汤合桃红四物汤
D. 天王补心丹合膈下逐瘀汤
E. 通窍活血汤合天王补心丹

正确答案：C。黄连温胆汤合桃红四物汤

解析：短暂性脑缺血发作痰瘀互结、阻滞脉络证症状：头晕目眩，头重如蒙，肢体麻木，胸脘痞闷，或猝然半身不遂，移时恢复如常，舌质暗，苔白腻或黄厚腻，脉滑数或涩。治法：豁痰化瘀，通经活络。方剂：黄连温胆汤合桃红四物汤加减（C对）。短暂性脑缺血的气虚血瘀，脉络瘀阻证症状：头晕目眩，动则加剧，猝然言语謇涩，或一侧肢体软弱无力，渐觉不遂，偶有肢体掣动，口角流涎，为时短暂，舌质暗淡，或有瘀点，苔白，脉沉细无力或涩。治法：益气，活血，通络。方剂：补阳还五汤加减（A错）。肝肾阴虚、风阳上扰证症状：头晕目眩，甚则欲仆，目胀耳鸣，心中烦热，多梦健忘，肢体麻木，或猝然半身不遂，言语謇涩，但瞬时即过，舌质红，苔薄白或少苔，脉弦或细数。治法：平肝息风，育阴潜阳。方剂：镇肝息风汤加减（B错）。天王补心丹合膈下逐瘀汤、通窍活血汤合天王补心丹不是短暂性脑缺血的证型方药（D错，E错）。